对幽门螺杆菌有强杀菌作用的是
A. 阿莫西林
B. 青霉素G
C. 红霉素
D. 奥美拉唑
E. 氨苄西林

正确答案：A。阿莫西林